葡萄酒斑状血管瘤属于
A. 毛细管型血管瘤
B. 海绵状血管瘤
C. 混合型血管瘤
D. 蔓状血管瘤
E. 杨梅状血管瘤

正确答案：A。毛细管型血管瘤

解析：本题考查微静脉畸形。血管畸形分为毛细血管畸形（微静脉）、静脉畸形、动脉畸形、动静脉畸形、淋巴管畸形和混合畸形。毛细管型由大量错杂交织的扩张的毛细血管构成，又可分为三类：葡萄酒斑状血管瘤（A对）、杨梅状血管瘤（E错）、腮腺毛细血管瘤。静脉畸形传统分类称海绵状血管瘤（B错）。动静脉畸形即传统分类中的蔓状血管瘤（D错）。存在一种类型以上的脉管畸形时，都可称为混合型脉管畸形（C错）。